手用不锈钢根管切削器械ISO规格尺寸规定工作端切割刃的长度为
A. 10mm
B. 13mm
C. 16mm
D. 25mm
E. 18mm

正确答案：C。16mm

解析：手用不锈钢根管切削器械ISO规格尺寸规定工作端切割刃的长度为16mm。掌握“髓腔进入与初预备”知识点。